釉基质形成正常但无明显的矿化，分常染色体显性、常染色体隐性两种亚型为下列哪种类型
A. 釉质形成不全
B. 釉质成熟不全
C. 釉质钙化不全
D. 遗传性乳光牙本质
E. 畸形中央尖

正确答案：C。釉质钙化不全

解析：釉质钙化不全型：釉基质形成正常但无明显的矿化，分常染色体显性、常染色体隐性两种亚型。掌握“釉质形成缺陷（釉质发育不全）”知识点。